可作为诊断单纯疱疹病毒性脑炎依据的是
A. 发热，惊厥伴口唇疱疹
B. 嗜睡，头痛伴失语
C. 发热，惊厥伴两侧以耳垂为中心肿胀
D. 烦躁，易激惹伴前囟饱满
E. 呕吐，血压升高，惊厥伴斑丘疹

正确答案：A。发热，惊厥伴口唇疱疹

解析：单纯疱疹病毒性脑炎，其临床表现为在疱疹性口炎的病程中出现发热、头痛、呕吐、嗜睡、颈强直等，故可作为诊断单纯疱疹病毒性脑炎依据的是发热，惊厥伴口唇疱疹（A对）。嗜睡，头痛伴失语（B错）需注意颅内出血或者颅内占位性病变。发热，惊厥伴两侧以耳垂为中心肿胀（C错）需注意腮腺炎病毒性脑炎。烦躁，易激惹伴前囟饱满（D错）需注意化脓性脑膜炎。呕吐，血压升高，惊厥伴斑丘疹（E错）需注意肠道病毒性脑炎。